胰岛素临床主要用于治疗
A. 糖尿病酮症酸中毒
B. 利尿
C. 甲状腺功能亢进症
D. 血压升高
E. 高血糖

正确答案：E。高血糖

解析：本题考查胰岛素的临床作用。胰岛素临床主要用于治疗高血糖（E对）。胰岛素可降低血糖水平，适用于2型糖尿病。糖尿病酮症酸中毒（A错）治疗的首要步骤是补液，同时小剂量胰岛素持续静脉滴注。利尿剂（B错）有呋塞米、螺内酯等。甲状腺功能亢进症（C错）常用大剂量碘或丙硫氧嘧啶进行治疗。血压升高（D错）常用降压药如卡托普利、厄贝沙坦等进行治疗。